某女，25岁。干咳少痰，不易咳出，鼻燥咽干。舌红少津，脉细数。辨证为燥邪伤肺，治宜选用的方剂是
A. 桑菊饮
B. 百合固金汤
C. 桑杏汤
D. 清金化痰汤
E. 银翘散

正确答案：C。桑杏汤

解析：本题考查的是咳嗽的辨证论治。辨证为燥邪伤肺，宜选用的方剂是桑杏汤（C对）。咳嗽是指肺失宣降，肺气上逆作声，或伴咳吐痰液，为肺系疾病的主要表现之一。（一）风寒袭肺证：【方剂应用】基础方剂为三拗汤（麻黄、杏仁、甘草）合止嗽散（桔梗、荆芥、甘草、白前、陈皮、百部、紫菀）加减。（二）风热犯肺证：【方剂应用】基础方剂为桑菊饮（A错）（桑叶、苦杏仁、芦根、菊花、甘草、连翘、薄荷、桔梗）加减。（三）风燥伤肺证：【方剂应用】基础方剂为桑杏汤（桑叶、苦杏仁、沙参、象贝、香豉、栀子、梨皮）加减。（四）痰湿蕴肺证：【方剂应用】基础方剂为二陈平胃散（陈皮、半夏、茯苓、甘草、苍术、厚朴）合三子养亲汤（紫苏子、白芥子、莱菔子）加减。（五）痰热郁肺证：【方剂应用】基础方剂为清金化痰汤（D错）（黄芩、栀子、桔梗、麦冬、桑白皮、贝母、知母、瓜蒌仁、橘红、茯苓、甘草）加减。（六）肺阴亏耗证：【方剂应用】基础方剂为沙参麦冬汤（沙参、玉竹、生甘草、冬桑叶、麦冬、生扁豆、天花粉）加减。【中成药应用】常用中成药有养阴清肺膏、百合固金丸（B错）、二冬膏。银翘散（E错）为风热感冒的方剂应用。风热感冒：【方剂应用】基础方剂为银翘散（金银花、连翘、竹叶、荆芥、牛蒡子、薄荷、桔梗、淡豆豉、甘草）加减。